下列属于三级信息源的是
A. 《中国国家处方集》
B. 《中国医院药学杂志》
C. 《中国药学杂志》
D. 《中国执业药师杂志》
E. 《中国药学会年会论文集》

正确答案：A。《中国国家处方集》

解析：本题考查药物信息的分类。《中国国家处方集》（A对）是从原创性研究中提取出被广泛接受的信息，对之进行评估而发表的结果，属于三级信息资源。《中国医院药学杂志》（B错）、《中国药学杂志》（C错）、《中国执业药师杂志》（D错）、《中国药学会年会论文集》（E错）均为一级信息源。